男，62岁。左侧胸痛伴呼吸困难1天。疼痛呈持续性锐痛，咳嗽时加剧，无放射痛发热。查体：BP110/80mmHg，呼吸急促，口唇发绀，双肺未闻及干湿啰音，P₂亢进，各瓣膜区未闻及杂音，左下肢水肿。胸痛最可能的原因是
A. 肺炎
B. 气胸
C. 肺梗死
D. 胸膜炎
E. 心绞痛

正确答案：C。肺梗死

解析：患者突发左侧持续性胸痛伴呼吸困难，无放射痛和发热，P₂亢进提示肺动脉高压，左下肢水肿提示体循环淤血，根据其临床表现和体征，可考虑诊断为肺血栓栓塞症，胸痛最可能的原因是肺梗死（C对）（肺梗死是指肺动脉发生栓塞后，其支配区的肺组织因血流受阻或中断而发生的坏死）。肺炎（P42）（A错）可伴胸痛、呼吸困难，但肺炎有相应肺部和全身感染的表现，如咳脓性痰伴寒战、高热等。气胸（P120）（B错）也可突发胸痛、呼吸困难，但气胸疼痛呈针刺样或刀割样，听诊呼吸音减弱或消失，一般无P₂亢进，无体循环淤血表现。胸膜炎（D错）常突发胸痛，可有呼吸困难，但胸膜炎典型的胸痛为刺痛，一般无P₂亢进，无体循环淤血表现。心绞痛（P219）（E错）可突发胸痛，呈放射性疼痛，一般无呼吸困难的表现，且一般持续数分钟至十余分钟，很少超过半小时。